糖尿病患者不宜选用的药物剂型是
A. 雾剂
B. 胶囊剂
C. 滴丸
D. 煎膏剂
E. 酒剂

正确答案：D。煎膏剂

解析：本题考查的是煎膏剂的特点。糖尿病患者不宜选用的药物剂型是煎膏剂（D对）。煎膏剂：系指中药饮片用水煎煮，煎液浓缩，加炼蜜或炼糖（或转化糖）制成的半流体制剂，俗称膏滋。煎膏剂在制备过程中需要加入大量炼蜜或炼糖（或转化糖），所以糖尿病患者不宜服用。雾剂（A错）指气雾剂与喷雾剂。气雾剂系指原料药物或原料药物和附加剂与适宜的抛射剂共同装封于具有特制阀门系统的耐压容器中，使用时借助抛射剂的压力将内容物呈雾状物喷出，用于肺部吸入或直接喷至腔道黏膜、皮肤的制剂。喷雾剂系指原料药或与适宜辅料填充于特制的装置中，使用时借助手动泵的压力、高压气体、超声振动或其他方法将内容物呈雾状物释出，用于肺部吸入或直接喷至腔道黏膜及皮肤等的制剂。胶囊剂（B错）系指原料药物或与适宜辅料充填于空心胶囊或密封于软质囊材中制成的固体制剂。滴丸（C错），即用滴制法制成的丸剂，系指原料药与适宜的基质加热熔融混匀，滴入不相混溶、互不作用的冷凝介质中制成的球形或类球形制剂。酒剂（E错）系指中药饮片用蒸馏酒提取制成的澄清液体制剂。